我国甲型肝炎感染率的地区分布特点是
A. 北高南低，西高东低，农村低城市高
B. 北低南高，西高东低，农村低城市高
C. 北高南低，西高东低，农村高城市低
D. 北高南低，西低东高，农村低城市高
E. 北高南低，西低东高，农村高城市低

正确答案：C。北高南低，西高东低，农村高城市低